肠系膜下动脉
A. 进入小肠系膜根
B. 起自肠系膜上动脉
C. 向下延续为直肠上动脉
D. 向下延续为盲肠下动脉
E. 起自腹腔干

正确答案：C。向下延续为直肠上动脉

解析：肠系膜下动脉起自腹主动脉（BE错）。直肠上动脉（C对D错）为肠系膜下动脉的直接延续。